可沉淀胶液中泥沙等杂质，并能增加胶剂透明度的辅料是
A. 明矾
B. 冰糖
C. 花生油
D. 黄酒
E. 白酒

正确答案：A。明矾

解析：本题考查的是胶剂辅料的种类与作用。可沉淀胶液中泥沙等杂质，并能增加胶剂透明度的辅料是明矾（A对）。胶剂辅料的种类与作用：①冰糖（B错）：色白、洁净无杂质者为佳。冰糖可增加胶剂的透明度和硬度，并有矫味作用。也可用白糖代替。②油类：可用花生油（C错）、豆油、麻油，纯净无杂质的新制油为佳，酸败者禁用。油可降低胶块的黏度，便于切胶，且在浓缩收胶时，油可促进锅内气泡的逸散，起消泡的作用。③酒类：多用绍兴黄酒（D错），也可用白酒（E错）代替。酒起矫味矫臭作用，收胶时有利于气泡逸散。④明矾：色白洁净者为佳。可沉淀胶液中的泥沙杂质，增加胶剂的透明度。